新生儿，诊断为单侧完全性唇裂合并单侧完全性腭裂，同时伴有鼻部畸形。最先实施的手术治疗是唇裂整复术，腭裂的正畸治疗应开始于新生儿无牙期，何时行鼻部畸形手术修复
A. 行唇裂整复术时同时修复鼻部畸形
B. 行腭裂整复术时同时修复鼻部畸形
C. 4～6岁时
D. 13岁左右
E. 20岁左右

正确答案：D。13岁左右

解析：本题考查行鼻部畸形手术修复的时间。对在婴幼儿期施行唇裂整复的同时是否进行鼻畸形的矫治问题，目前尚无一致的意见。多数学者认为：婴幼儿期施行鼻畸形矫治术，因过多地剥离鼻翼软骨而损伤其软骨膜，从而影响鼻翼软骨的生长发育，导致成年后出现难以矫正的鼻翼不对称畸形，因而主张推迟到13岁（D对）以后进行根治性鼻畸形矫正术。但也有学者认为：在唇裂整复术中，广泛暴露鼻翼软骨并进行重建手术，并不会影响到后期鼻翼软骨的生长发育，主张在婴幼儿期施行唇裂整复术时同时修复鼻部畸形（A错）。腭裂整复术主要是在口内，鼻部畸形矫治术在口外，不宜在行腭裂整复术时同时修复鼻部畸形（B错）。4～6岁（C错）时鼻翼软骨还不够多，若进行鼻畸形矫治术，过多地剥离软骨容易损伤其软骨面，从而影响鼻翼软骨发育。20岁左右（E错）时鼻部已经完全发育完成，其生长修复功能下降，手术效果不够好。